糖尿病酮症酸中毒的临床特点是
A. 呼吸浅慢，不规则
B. 呼吸困难伴发绀
C. 呼吸深大，呼气中有烂苹果味
D. 呼吸浅快，呼气中有大蒜味
E. 潮式呼吸

正确答案：C。呼吸深大，呼气中有烂苹果味

解析：糖尿病酮症酸中毒是各种诱因使体内胰岛素缺乏引起的糖、脂肪、蛋白质的严重代谢紊乱，出现高血糖、高酮血症、代谢性酸中毒为主要病变的临床综合征，临床特点有“三多一少”症状加重，病情迅速恶化，食欲减退，恶心呕吐，多尿，口干，头痛，嗜睡，呼吸深大，呼气中有烂苹果味（C对）。呼吸困难伴发绀（B错）为缺氧表现；呼吸浅快，呼气中有大蒜味（D错）为有机磷中毒的表现；潮式呼吸（E错）不是糖尿病酮症酸中毒的临床特点，常见于脑溢血、颅内压增高的病人。